治疗地高辛引起的室性早搏（期前收缩）的首选药是
A. 奎尼丁
B. 苯妥英钠
C. 利多卡因
D. 胺碘酮
E. 普鲁卡因胺

正确答案：B。苯妥英钠

解析：地高辛中毒最多见与最早见的室性期前收缩（室性早搏），苯妥英钠可以与强心苷竞争Na+-K+-ATP酶，恢复该酶的活性，因而成为治疗强心苷中毒引起快速性心律失常的首选药物。掌握“强心苷、ACE抑制剂”知识点。